有使下颌骨向前并降下颌骨作用的是
A. 咬肌
B. 颞肌
C. 翼内肌
D. 翼外肌
E. 舌骨上肌群

正确答案：D。翼外肌

解析：翼外肌有上、下两头，上头起于蝶骨大翼的颞下面和颞下嵴；下头起于翼外板的外侧面，向后外方走行，止于髁突颈部的关节翼肌窝、关节囊和关节盘。功能：使下颌骨向前并降下颌骨。掌握“咀嚼肌、颈部肌及口颌系统肌链”知识点。